性温，既补肾，又祛风湿的药是
A. 续断
B. 狗脊
C. 骨碎补
D. 桑寄生
E. 雷公藤

正确答案：B。狗脊

解析：本题考查的是狗脊的性味归经与功效。性温，既补肾，又祛风湿的药是狗脊（B对）。狗脊：【性味归经】苦、甘，温。归肝、肾经。【功效】补肝肾，强腰膝，祛风湿。续断（A错）：【性味归经】苦、甘、辛，微温。归肝、肾经。【功效】补肝肾，行血脉，续筋骨。骨碎补（C错）：【性味归经】甘、苦，温。归肝、肾经。【功效】补肾，活血，止痛，续伤。桑寄生（D错）：【性味归经】苦、甘，平。归肝、肾经。【功效】祛风湿，补肝肾，强筋骨，安胎。雷公藤（E错）：【性味归经】苦、辛，凉。有大毒。归心、肝经。【功效】祛风除湿，活血通络，消肿止痛，杀虫解毒。